普鲁卡因不适用于
A. 阻滞麻醉
B. 冷冻麻醉
C. 表面麻醉
D. 雾化吸入
E. 浸润麻醉

正确答案：C。表面麻醉

解析：本题考查常用局麻药-普鲁卡因。普鲁卡因不适用于表面麻醉（C错，为本题的正确答案）。普鲁卡因属短效酯类局麻药，亲脂性低，对黏膜的穿透力弱，一般不用于表面麻醉。可用于阻滞麻醉（A对）、冷冻麻醉（B对）、雾化吸入（D对）和浸润麻醉（E对）。